临床表现为先出血，微血栓形成，继而发生微循环障碍及溶血等一系列严重出血性综合征，属于
A. 肾病综合征
B. 肝性脑病
C. 血友病
D. 白血病
E. DIC

正确答案：E。DIC

解析：弥散性血管内凝血（DIC）是许多疾病发展过程中的一组复杂病理过程，是一种严重的出血性综合征，临床表现为出血、微血栓形成、微循环障碍及溶血等。掌握“弥散性血管内凝血（DIC）”知识点。